确诊流行性乙型脑炎常检查的抗体是
A. 特异性IgM抗体
B. 血凝抑制抗体
C. 血凝素抗体
D. 中和抗体
E. 补体结合抗体

正确答案：A。特异性IgM抗体

解析：特异性IgM抗体（A对）在乙脑病后3～4天即可出现，脑脊液中最早在病程第二天即可检测到，2周时达高峰，可作为早期诊断指标，为确诊流行性乙型脑炎常检查的抗体。血凝抑制抗体（B错）是指由表面含有血凝素的病毒，刺激机体产生的抗体。血凝素抗体（C错）是红细胞上凝集素的抗体，与流行性乙型脑炎无关。中和抗体（D错）是当病原微生物侵入机体时会产生相应的抗体，临床并不常用，且中和抗体一般为毒株特异性，即不具有广泛交叉反应性，一旦发生抗原表位突变，即丧失中和作用。补体结合抗体（E错）是指应用可溶性抗原，加蛋白质、多糖、类脂质、病毒等，与相应抗体结合，其抗原抗体复合物可以结合补体。